全部由浆液性腺泡组成，故属纯浆液腺的是
A. 腮腺
B. 下颌下腺
C. 舌下腺
D. 唇腺
E. 腭腺

正确答案：A。腮腺

解析：腮腺全部由浆液性腺泡组成，故属纯浆液腺，但在新生儿的腮腺中可见少量黏液细胞。腮腺闰管长，有分支；分泌管多，染色浅。掌握“唾液腺组织学特点”知识点。